关于牙龈瘤的叙述，哪项是错误的
A. 女性多见，与内分泌有关
B. 可以破坏牙槽骨壁
C. 一般应将病变波及的牙齿拔除
D. 病变波及的骨膜及邻近骨组织需要去除
E. 因非真性肿瘤，切除后不易复发

正确答案：E。因非真性肿瘤，切除后不易复发

解析：牙龈瘤女性较多，随着肿块的增长，可以破坏牙槽骨壁。其治疗方法传统观点认为应将病变所波及的牙齿同时拔除。应围绕病变周围的正常组织上做切口，将肿块完全切除，拔除波及的牙齿，并用刮匙或骨钳将病变波及的牙周膜、骨膜及邻近的骨组织去除。牙龈瘤为非真性肿瘤，但是复发倾向明显。掌握“牙龈瘤”知识点。